男，4岁。高热腹痛腹泻1天，为粘液脓血便，伴里急后重，反复惊厥，逐渐出现昏睡神志不清，病前吃过未洗黄瓜。有助于确诊的检查是
A. 血培养
B. 大便常规
C. 粪便培养
D. 免疫学检测
E. 外周血象

正确答案：C。粪便培养

解析：4岁男性患儿，发病突然（发病急骤），病前吃过未洗黄瓜（食用过不洁食物，志贺菌经粪口途-径传播），高热腹痛腹泻伴里急后重，为粘液脓血便（急性细菌性痢疾典型消化道症状），反复惊厥，逐渐出现昏睡神志不清（出现全身中毒症状），结合患儿的临场症状和既往史，最有可能的诊断是急性细菌性痢疾，病原菌是志贺菌（痢疾杆菌），有助于诊断的是粪便培养（C对），培养出痢疾杆菌（志贺菌）可以确诊。血培养（A错）不用于志贺菌的诊断，因为志贺菌感染几乎只局限在肠道，一般不入侵血液，只释放内毒素入血（P115）。急性细菌性痢疾白细胞总数可轻至中度增多，以中性粒细胞为主；粪便常规时粪便外观多为粘液脓血便，镜检可见白细胞、脓细胞和少数红细胞，血常规（外周血象）（E错）和大便常规（B错）都属于一般检查，对确诊病原体没有特异性，可辅助诊断（八版传染病学P180）。免疫学检查（D错）具有早期、快速的优点，但由于粪便中成分复杂，易出现假阳性（八版传染病学P181）。